治疗缺铁性贫血脾气虚弱证，应首选
A. 香砂六君子汤
B. 八珍汤
C. 四神丸
D. 四物汤
E. 金匮肾气丸

正确答案：A。香砂六君子汤

解析：脾气虚弱证，治宜健脾和胃，益气养血，首选益气健脾，行气化痰的香砂六君子汤（A对）。八珍汤功用益气补血，养心安神是治疗缺铁性贫血气血两虚证的代表方（B错）。四神汤补益脾阴，厚实肠胃，是中医著名的健脾食方，用于治疗脾虚，脾阴不足，消化不良等（C错）。四物汤功用补血和血，适用于营血虚滞证（D错）。金匮肾气丸补肾助阳，化生肾气，适用于肾阳气不足证（E错）。